加速毒物排出体外的是
A. 导泻
B. 洗肠
C. 利尿
D. 血液净化
E. 吸氧

正确答案：A、B、C、D。导泻；洗肠；利尿；血液净化

解析：本题考查中毒解救。加速毒物排泄,减少吸收的方法：1.导泻（A对）；2.洗肠（B对）；3.利尿（C对）；4.血液净化（D对）。吸氧（E错）用于纠正缺氧没有加速毒物排出体外的作用。